以下关于热疗的描述，不恰当的是
A. 热疗与化疗联合应用，可起到同步化增效作用
B. 微波热疗是目前最常用的加热技术
C. 高温治疗恶性肿瘤疗效好，不存在问题
D. 可分为全身加热和局部加热两类
E. 局部热疗对患者痛苦少，易于接受，并发症少

正确答案：C。高温治疗恶性肿瘤疗效好，不存在问题

解析：高温治疗恶性肿瘤虽然取得一定的疗效，但也还存在一些问题，如测温技术，热疗合并放疗和化疗的顺序、热疗的温度和时间，热疗中的防护，以及消除热疗耐受性的方法等均需要进一步探索。掌握“口腔颌面部肿瘤的治疗原则及预防”知识点。